治疗急性白血病的药物中，易引起凝血因子减少的是
A. 阿糖胞苷
B. 长春新碱
C. 柔红霉素
D. 左旋门冬酰氨酶
E. 足叶乙甙

正确答案：D。左旋门冬酰氨酶

解析：治疗急性白血病的药物中，易引起凝血因子减少的是左旋门冬酰氨酶（L-ASP）（D对），其主要副作用为肝功能损害、胰腺炎、凝血因子及清蛋白合成减少和过敏反应；阿糖胞苷（Ara-C）（A错）主要副作用为小脑共济失调、皮疹、发热、眼结膜炎等；长春新碱（VCR）（B错）主要副作用为末梢神经炎和便秘；柔红霉素（DNR）（C错）主要副作用为心脏毒性；足叶乙苷即依托泊苷（E错）主要副作用为骨髓抑制、消化道反应、脱发、低血压等。